按照《药品包装、标签规范细则（暂行）》，大包装、中包装、最小销售单元包装和标签上必须印有符合规定的标志是
A. 麻醉药品、外用药品
B. 非处方药品、精神药品
C. 放射性药品
D. 医疗用毒性药品
E. 以上都是

正确答案：E。以上都是

解析：本题考查药品包装。按照《药品包装、标签规范细则（暂行）》，大包装、中包装、最小销售单元包装和标签上必须印有符合规定的标志是麻醉药品、精神药品、医疗用毒性药品、放射性药品、外用药品和非处方药品（E对）等。